女35岁，左上5缺失，左上46固定修复，一个月脱落，检查46全冠预备体完好，高度约4mm，颌间隙2mm，轴面聚合角度＞20°，冠边缘位于颈部龈下0.5mm，无肩台。重新修复的话正确的做法
A. 颈部预备至龈下1mm
B. 根管治疗后冠修复
C. 增加3做基牙
D. 根管治疗后桩核修复增加高度
E. 边缘改为原角肩台

正确答案：D。根管治疗后桩核修复增加高度

解析：本题考查桩核冠修复。根据题干得知该患者为固定修复，46全冠预备体完好，高度约4mm，颌间隙2mm（提示高度不足，间隙过大），再结合修复体冠边缘位于颈部龈下0.5mm，无肩台。因此重新修复的话正确的做法为根管治疗后桩核修复增加高度（D对）。颈部预备至龈下1mm（A错）、根管治疗后冠修复（B错）、增加3做基牙（C错）、边缘改为原角肩台（E错）均不能有效解决题干中患者修复体脱落的问题，故不采用。